主人体生殖的阴精是
A. 肾精
B. 天癸
C. 月水
D. 水谷精微
E. 五脏六腑之精

正确答案：A。肾精

解析：肾为先天之本、元气之根，肾藏精、主生殖，人体的形成、生长发育、生殖主要靠精的化生来实现，肾精不足则生殖机能减退（A对）。天癸是肾精充盛到一定程度时体内出现的具有促进人体生长、发育和生殖的一种精微物质，非主人体生殖的阴精（B错）。月水即月经，月经的初潮标志着已初具有生殖功能，非主人体生殖的阴精（C错）。后天之水谷精微于先天禀受于父母的生命物质共同构成肾精，精藏于肾，依赖肾的贮藏作用和施泄作用发挥其主生殖的生理功能（D错）。五脏六腑之精藏于肾，是肾精的组成部分，非主人体生殖的阴精（E错）。